拟定补中益气汤的医家是
A. 张仲景
B. 钱乙
C. 李东垣
D. 张景岳
E. 秦景明

正确答案：C。李东垣

解析：张仲景在《金匮要略·血痹虚劳病脉证并治》用小建中汤治疗手足烦热（A错）。宋代钱乙在《小儿药证直诀》中将肾气丸化裁为六味地黄丸，为阴虚内热的治疗提供了一个重要的方剂（B错）。金元李东垣以其拟定的补中益气汤作为治疗气虚发热的主要方剂（C对）。明代张景岳在《景岳全书·寒热》中用右归饮、理中汤、大补元煎、六味回阳饮等治疗阳虚发热（D错）。秦景明在《症因脉治·内伤发热》中明确提出“内伤发热”的病证名，拟定的气虚柴胡汤及血虚柴胡汤可作为气虚发热及血虚发热的参考方（E错）。